位于上颌侧切牙和尖牙之间的倒梨形囊状透射区
A. 含牙囊肿
B. 残余囊肿
C. 正中囊肿
D. 球上颌囊肿
E. 鼻腭管囊肿

正确答案：D。球上颌囊肿

解析：本题考查球上颌囊肿。位于上颌侧切牙和尖牙之间的倒梨形囊状透射区为球上颌囊肿（D对）。球上颌囊肿：位于上颌侧切牙和尖牙之间的倒梨形囊状透射区，侧切牙和尖牙牙髓活力正常。